香烟烟雾的化学物质中能够使人体内红细胞失去携氧能力的是
A. 尼古丁
B. 焦油
C. 致癌物
D. 烟尘
E. 一氧化碳

正确答案：E。一氧化碳